提示非ST段抬高型急性冠状动脉综合征患者预后不良最有价值的线索是
A. 最近48小时症状反复发作
B. 发作时血压下降
C. 血肌钙蛋白水平增高
D. 发作时间超过30分钟
E. 有静息胸痛发作

正确答案：B。发作时血压下降

解析：按非ST 段抬高型心梗危险分层标准(ESC 标准），具有下列特点之一者属极高危组：通过正规、强化药物治疗后仍有心绞痛发作；症状发作时伴严重心力衰竭；症状发作时合并危及生命的室性心律失常；症状发作时血流动力学不稳定。本例发作时血压下降， 血流动力学不稳定，属于极高危患者（B对） 。血清肌钙蛋白水平升高（C错）属于高危组而不是极高危组。